在药品处方中，可作为粉末直接压片用黏合剂的是
A. 羧甲基纤维素钠（CMC-Na）
B. 羟丙基甲基纤维素（HPMC）
C. 乙基纤维素（EC）
D. 甲基纤维素（MC）
E. 羟丙基纤维素（HPC）

正确答案：E。羟丙基纤维素（HPC）

解析：本题考查粉末直接压片用黏合剂。羟丙基纤维素（E对）可作粉末直接压片黏合剂。